足厥阴肝经与手太阴肺经交接的部位是
A. 胸中
B. 中焦
C. 心中
D. 肺中
E. 腋下

正确答案：D。肺中

解析：足厥阴肝经与手太阴肺经交接的部位是肺中（D对）。足少阴肾经与手厥阴心包经交接于胸中（A错）。足太阴脾经与手少阴心经交接与心中（C错）。